下列哪项属于双侧侧腭突及鼻中隔未融合或部分融合的结果
A. 腭裂
B. 唇裂
C. 颌裂
D. 下颌裂
E. 斜面裂

正确答案：A。腭裂

解析：腭裂是口腔较常见的畸形，为一侧侧腭突和对侧侧腭突及鼻中隔未融合或部分融合的结果。掌握“腭部与舌的发育”知识点。